依据Poiseuille公式，关于滤过的正确表述有
A. 操作压力越大，滤速越快
B. 加压过滤法可提高滤速
C. 减压过滤法可降低滤速
D. 滤液黏度越大，滤速越快
E. 滤层越厚，滤速越慢

正确答案：A、B、E。操作压力越大，滤速越快；加压过滤法可提高滤速；滤层越厚，滤速越慢